符合医学伦理学研究的是
A. 研究人与人之间关系的科学
B. 研究人与社会之间关系的科学
C. 研究医学活动中的道德关系和道德现象的科学
D. 研究道德的形成本质及其发展规律的科学
E. 道德科学或道德哲学

正确答案：C。研究医学活动中的道德关系和道德现象的科学

解析：医学伦理学研究的是医疗领域中的道德关系和道德现象（C对），它同当时的社会经济、医学状况有着密切的联系，并深受当时社会政治、法律、文化、宗教等社会意识形态的影响。道德是由社会的经济基础决定的，以善恶、正当与否、该不该等作为评价标准，借助自律和他律来调节人与人（A错）、人与社会（B错）、人与自然之间的关系，并追求自身人格完善的活动、关系或意识的总称。道德贯穿在社会生活的各个层面，如社会公德、家庭美德和职业道德等。道德也指个人的道德信念、道德情感、道德品格、道德理想和道德实践。